急性风湿热治疗时，早期使用糖皮质激素的指征是
A. 环形红斑
B. 多发性关节炎
C. 心脏炎
D. 皮下小结
E. 舞蹈病

正确答案：C。心脏炎

解析：风湿热是一种咽喉部A组乙型溶血性链球菌感染后反复发作的全身结缔组织炎症，临床表现以关节炎和心脏炎为主，可伴有发热、皮疹、皮下结节、舞蹈病等。急性风湿热治疗时，早期使用糖皮质激素的指征是心脏炎（C对AD错）。若出现舞蹈病（E错），应首选丙戊酸，该药无效或严重舞蹈病如瘫痪的患者，应用卡马西平治疗。伴有多发性关节炎（B错）者一般首选非甾体抗炎药，常用阿司匹林。